初产妇，21岁。胎儿娩出后两分钟出现多量阴道流血。最有可能的诊断是
A. 凝血功能障碍
B. 阴道静脉破裂
C. 胎盘剥离不全
D. 宫颈裂伤
E. 宫缩乏力

正确答案：C。胎盘剥离不全

解析：青年初产妇，胎儿娩出后数分钟出现大量阴道流血，应考虑为胎盘因素，如胎盘剥离不全（C对）、嵌顿、粘连、植入等。凝血功能障碍（A错）导致的产后出血表现为胎儿娩出后阴道持续流血，且血液不凝。阴道静脉破裂（B错）出血一般出血量不大，且多发生于分娩过程中。宫颈裂伤（软产道裂伤）（D错）导致的产后出血表现为胎儿娩出后立即发生阴道流血，色鲜红。子宫收缩乏力（E错）所致的产后出血的主要表现为胎盘娩出后，间断性出血（阵发性出血），即子宫收缩时出血量较少，子宫松弛时出血量较多（时多时少）。